噻孢霉素钠的氯化钠等渗当量为0.24，配置2%滴眼液100ml需加多少克氯化钠
A. 0.42g
B. 0.61g
C. 0.36g
D. 1.42g
E. 1.36g

正确答案：A。0.42g

解析：本题考查等渗浓度的计算。氯化钠等渗当量法指与1g的药物成等渗的氯化钠质量。等渗调节剂的用量计算公式：W=（0.9-C×E）×V/100。其中w为配制等渗溶液需加入的氯化钠的量（g），V为溶液的体积（ml），E为等渗当量，C为溶液中药物的百分浓度。根据题目中已知条件，噻孢霉素钠的氯化钠等渗当量E为0.24，带入C=2%；V=100mL，应加入氯化钠的量=（0.9-2×0.24）×100/100=0.42（g）（A对）。